盆腔放射治疗后导致的闭经属于
A. 子宫性闭经
B. 卵巢性闭经
C. 垂体性闭经
D. 肾上腺性闭经
E. 下丘脑性闭经

正确答案：A。子宫性闭经

解析：子宫性闭经的病因包括感染、创伤导致宫腔粘连引起的闭经。盆腔放射治疗后破坏子宫内膜导致子宫性闭经（A对）。卵巢性闭经（P354）（B错）多因卵巢早衰、卵巢功能性肿瘤或多囊卵巢综合症引起卵巢分泌的性激素水平低下，子宫内膜不发生周期性变化而导致的闭经。垂体性闭经（P354）（C错）多因垂体梗死、垂体肿瘤或空碟鞍综合征引起腺垂体器质性病变或功能失调，继而影响卵巢功能而导致的闭经。下丘脑性闭经（P353）（E错）多因精神应激、体重下降或颅咽管瘤等而引起中枢神经系统及下丘脑各种功能和器质性病变从而导致的闭经。